男性，12岁。误服有机磷农药1605（对硫磷）一口，急送医院就诊，当时测定胆碱酯酶活力为54%。重症有机磷中毒患者血清胆碱酯酶活力应为
A. ﹤30%
B. ﹤45%
C. ﹤50%
D. ﹤75%
E. 1

正确答案：A。﹤30%